片剂硬度不够产生的原因是
A. 黏合剂用量不足或黏性不够
B. 压片时压力过大
C. A和B均是
D. A和B均不是

正确答案：A。黏合剂用量不足或黏性不够

解析：本题考查片剂制备中的常见问题及原因。片剂硬度不够，稍加触动即散碎的现象称为松片，主要原因是黏性力差（A对），压缩压力不足（BCD错）等。